依据舌诊脏腑部位分属，舌尖属于
A. 肝胆
B. 心肺
C. 肾
D. 大肠
E. 脾胃

正确答案：B。心肺

解析：舌面以五脏来划分，各家学说略有不同，但比较一致的意见是：舌尖属心肺（B对），舌边属肝胆（A错），舌中心属脾胃（E错），舌根属肾（C错）。